尿血，胁痛，口苦咽干，烦躁易怒。舌质红，苔薄黄，脉弦。其证型是
A. 肝郁气滞
B. 湿热下注
C. 气血两虚
D. 瘀血内阻
E. 脾肾两虚

正确答案：A。肝郁气滞

解析：患者胁痛，提示肝气不舒，因胁肋部为肝经循行处。伴口苦、烦躁易怒，提示内有热邪为患。舌脉亦提示肝气郁滞，内有郁热，综合此病例可诊断为肝郁气滞证（A对）。膀胱癌湿热下注（B错）证见尿血，尿频数，尿痛，小腹胀痛，口渴不欲饮。舌质红，苔黄腻，脉滑数。膀胱癌气血两虚（C错）证见尿血，面色苍白，倦怠乏力，自汗，盗汗；舌质淡，苔薄白，脉沉细无力。膀胱癌无瘀血内阻（D错）、脾肾两虚（E错）这两个证型。